能引起儿童软骨发育不良的药物是
A. 呋喃唑酮
B. 甲氧苄啶
C. 氧氟沙星
D. 磺胺嘧啶
E. 甲硝唑

正确答案：C。氧氟沙星

解析：喹诺酮类药物能引起幼龄动物出现软骨组织损害，特别是负重区软骨，年龄越小损害越严重。临床研究发现儿童用药后出现关节肿胀、疼痛等，故儿童、孕妇和哺乳期妇女不宜使用。常用的氟喹诺酮类药物有诺氟沙星（C对）。